泌尿系结石血尿特点是
A. 无痛性全程肉眼血尿
B. 终末血尿伴膀胱刺激征
C. 初始血尿
D. 疼痛伴血尿
E. 血红蛋白尿

正确答案：D。疼痛伴血尿

解析：全程无痛血尿见于肾脏肿瘤或者输尿管肿瘤（A错）。终末血尿见于提示膀胱病变（B错）。起始血尿提示病变位于尿道（C错）。疼痛伴血尿常见于泌尿系统结石（D对）。血红蛋白尿常见于泌尿系统结核（E错）。